区分五脏、六腑、奇恒之腑的最主要依据是
A. 解剖形态
B. 所在部位
C. 阴阳属性
D. 经脉络属
E. 功能特点

正确答案：E。功能特点

解析：内脏依据形态结构与生理机能特点分为脏、腑和奇恒之腑三类。五脏内部组织相对充实，共同生理机能是化生和贮藏精气；六腑多呈中空的囊状或管腔形态，共同的生理机能是受盛和传化水谷；奇恒之腑机能上贮藏精气与五脏相似，形态上中空有腔与六腑相类，似脏非脏，似腑非腑，故以奇恒之腑名之。最主要依据是功能特点（E对）。